男，51岁。腹痛伴腹胀1天，暴饮暴食后突然剧烈上腹痛，之后出现腹胀，停止排气、排便。查体：T38.2℃，P120次/分，R25次/分，BP135/73mmHg。腹部明显膨隆，双侧腰肋部皮下瘀斑，全腹肌紧张，压痛和反跳痛（+），肠鸣音消失。实验室检查：血清淀粉酶180U/L，WBC17×10⁹/L。关于该患者的肠内营养支持，正确的原则是
A. 血清淀粉酶恢复正常后即可以实施肠内营养
B. 在该患者病程中都不能肠内营养
C. 早期以肠内营养为主
D. 肠功能恢复后尽早实施肠内营养
E. 生命体征平稳后方可实施肠内营养

正确答案：D。肠功能恢复后尽早实施肠内营养

解析：重症胰腺炎的病人，早期营养支持以肠外营养为主（C错），早期肠内营养可促进胰液分泌，不利于胰腺修复。一旦肠功能恢复，尽早实施肠内营养（D对B错），以避免肠黏膜萎缩，影响肠道功能。血清淀粉酶发病后在4～5天即可恢复，但此时胰腺局部炎症反应仍严重，不宜实施肠内营养（A错）。多数患者经过禁食、补液、胃肠引流等临床处理，生命体征可趋于平稳，但此时胰腺组织尚未修复，尚不能实施肠内营养（E错）。